某地发生一起急性中毒事件，中毒37人，死亡2人。中毒及死亡患者早期呈酒醉状态，出现头昏、头痛、乏力视物模糊，严重者出现失明、呼吸困难、意识模糊、昏迷等。经调查发现所有患者发病前均食用了同一厂家生产的散装白酒。引起这事件的有毒成分可能为
A. 铅
B. 甲醇
C. 杂醇油
D. 氢氰酸
E. 亚硝酸盐中毒

正确答案：B。甲醇

解析：本题考查甲醇中毒。本题中中毒及死亡患者早期呈酒醉状态，出现头昏、头痛、乏力视物模糊，严重者出现失明、呼吸困难、意识模糊、昏迷等。可知其食用了含有甲醇（B对ACDE错）的散装白酒，甲醇具有剧烈的神经毒性，在体内代谢可生成毒性更强的甲醋和甲酸。主要侵害视神经，导致视网膜受损、视神经萎缩、视力减退和双目失明。